栓塞性微球的注射给药途径是
A. 皮内注射
B. 皮下注射
C. 动脉注射
D. 静脉注射
E. 关节腔注射

正确答案：C。动脉注射

解析：本题考查动脉注射。栓塞性微球的注射给药途径是动脉注射（C对）；栓塞性微球注射于癌变部位的动脉血管内，微球可阻滞在瘤体周围的毛细血管内，既可以切断肿瘤的营养供给，也可使载药的微球滞留在病变部位；皮内注射（A错）是将药物注射到真皮中，只用于诊断与过敏试验；皮下注射（B错）的吸收较肌内注射慢，一些需延长作用时间的药物可采用皮下注射；药物不宜口服、皮下或肌内注射，需迅速发生药效时，可采用静脉注射（D错）或静脉输液法；关节腔注射（E错）是关节腔穿刺技术的一种延伸，以膝关节为例，膝关节关节腔积液以后，通常采取膝关节腔穿刺术将里面的积液抽出，同时给予关节腔内注药。